雀啄灸属于
A. 天灸
B. 艾炷灸
C. 温针灸
D. 温灸器灸
E. 艾条灸

正确答案：E。艾条灸

解析：天灸又称药物灸，发泡灸，不属于艾灸（A错）。艾柱灸为艾灸的一种，可分为隔姜灸、隔蒜灸、隔盐灸等（B错）。温针灸为艾灸的一种（C错）。温灸器灸为艾灸的一种（D错）。雀啄灸属于艾条灸的悬起灸（E对）。